某医师，在去年8月至今年6月的执业活动中，为了从个体推销商手中得到好处，多次使用未经批准的药品和消毒药剂，累计获得回扣8205元。根据《执业医师法》的规定，应当依法给予该医师的行政处罚是
A. 警告
B. 责令暂停9个月执业活动
C. 罚款1万元
D. 吊销执业证书
E. 没收非法所得

正确答案：D。吊销执业证书

解析：该医师在执业活动中，曾多次使用未经批准的药品和消毒药剂，从个体推销商手中累计获得回扣8205元，情节严重。根据《执业医师法》，医师在执业活动中使用未经批准的药品和消毒药剂，县级以上人民政府卫生行政部门应当给予警告或者责令暂停6个月以上1年以下执业活动（AB错）；情节严重的，吊销其执业证书（D对）；构成犯罪的，依法追究刑事责任。